《药品不良反应报告和监测管理办法》规定负责组织药品不良反应监测方法的研究的部门是
A. 卫生部
B. 国家食品药品监督管理局会同卫生部
C. 国家食品药品监督管理局
D. 国家药品不良反应监测中心
E. 省、自治区、直辖市（食品）药品监督管理局

正确答案：D。国家药品不良反应监测中心

解析：本题考查药品不良反应报告和监测管理。负责组织药品不良反应监测方法的研究的部门是国家药品不良反应监测中心（D对）。《药品不良反应报告和监测管理办法》第十条：国家药品不良反应监测中心负责全国药品不良反应报告和监测的技术工作，并履行以下主要职责：（一）承担国家药品不良反应报告和监测资料的收集、评价、反馈和上报，以及全国药品不良反应监测信息网络的建设和维护；（二）制定药品不良反应报告和监测的技术标准和规范，对地方各级药品不良反应监测机构进行技术指导；（三）组织开展严重药品不良反应的调查和评价，协助有关部门开展药品群体不良事件的调查；（四）发布药品不良反应警示信息；（五）承担药品不良反应报告和监测的宣传、培训、研究和国际交流工作。